氯吡格雷主要经过的代谢酶是
A. CYP3A4
B. CYP2C19
C. CYP2D6
D. CYP1A2
E. CYP2C9

正确答案：B。CYP2C19

解析：本题考查氯吡格雷的代谢酶。氯吡格雷主要经由CYP2C19（B对）代谢。